心绞痛发作时，心电图出现的改变是
A. P波高尖
B. P-R间期延长
C. ST段水平压低0.1mV以上
D. 异常Q波
E. 完全性右束支传导阻滞

正确答案：C。ST段水平压低0.1mV以上

解析：ST水平型压低及下斜型压低对诊断心肌缺血有较大的临床意义（C对）。P波高尖，引起的原因有右心房肥大、肺动脉高压、低钾、甲亢等（A错）。PR间期延长，一般主要考虑为房室传导阻滞（B错）。增宽加深超过正常范围的Q波称为异常Q波，常见于心肌梗死等（D错）。完全性右束支传导阻滞出现继发性 ST-T改变：V₁、V₂导联ST段下移，T波倒置（E错）。